与水液代谢关系最密切的脏腑是
A. 脾、胃、肝
B. 肝、胆、肾
C. 肝、肺、脾
D. 肺、肾、脾
E. 心、肾、肺

正确答案：D。肺、肾、脾

解析：本题考查五脏与水液代谢的关系，属于理解记忆内容。因为肺气的宣发肃降，通调水道，对水液的输布通路有疏通和调节作用。肾为水脏，对津液输布代谢起着主宰作用。肾气具有主司和调节全身水液代谢的功能，脾气具有吸收、转输水精，调节水液代谢的功能，固肺、肾、脾所以水液代谢关系最密切（D对）。肝的主要生理功能是主疏泄和主藏血，不直接参与水液代谢（ABC错）。心的主要生理功能是主血脉，主藏神，同样不直接参与水液代谢（E错）。